含有2个胚层以上的肿瘤是
A. 骨母细胞瘤
B. 髓母细胞瘤
C. 软骨母细胞瘤
D. 性畸胎瘤
E. 动脉瘤

正确答案：D。性畸胎瘤

解析：性畸胎瘤（D对）来源于生殖细胞，大多数肿瘤含有2个以上胚层组织成分。骨母细胞瘤（A错）和软骨母细胞瘤（D错）为良性肿瘤，髓母细胞瘤（B错）为恶性肿瘤，三者均无2个以上胚层成分（P84）。动脉瘤（E错）虽然称为“瘤”，但不属于肿瘤。